川崎病急性期的最佳治疗药物是
A. 阿司匹林
B. 糖皮质激素
C. 丙种球蛋白
D. 糖皮质激素+阿司匹林
E. 丙种球蛋白+阿司匹林

正确答案：E。丙种球蛋白+阿司匹林

解析：虽然单独使用丙种球蛋白也可以治疗川崎病（C错），但丙种球蛋白+阿司匹林可预防冠状动脉病变的发生，所以川崎病急性期的最佳治疗药物是丙种球蛋白+阿司匹林（E对）。糖皮质激素可促进血栓的形成，加重冠状动脉病变（B错）。糖皮质激素+阿司匹林（D错）用于丙种球蛋白治疗无效患者。